上皮浅层破坏，未侵犯上皮全层为
A. 溃疡
B. 糜烂
C. 皲裂
D. 假膜
E. 棘层松解

正确答案：B。糜烂

解析：上皮浅层破坏，未侵犯上皮全层叫糜烂。黏膜或皮肤表层坏死而脱落形成凹陷为溃疡。掌握“口腔黏膜基本病理变化”知识点。